研究药物的剂型因素、用药对象的生物因素与临床药效间关系的科学是
A. 制剂学
B. 物理药学
C. 临床药学
D. 中药药剂学
E. 生物药剂学

正确答案：E。生物药剂学

解析：本题考查生物药剂学的含义。研究药物的剂型因素、用药对象的生物因素与临床药效间关系的科学是生物药剂学（E对）。生物药剂学：是研究药物及其制剂在体内吸收、分布、代谢与排泄的机理及过程，阐明药物因素、剂型因素、机体生物因素与药物疗效之间相互关系的学科。制剂学（A错）：制剂学是根据制剂理论和制剂技术，设计和制备安全、有效、稳定的药物制剂的学科，属于工业药剂学的范畴。物理药学（B错）：物理药学是以物理化学的基本理论研究药物理化性质和药剂学中有关剂型的性质。以患者为对象，研究合理、有效与安全用药的科学是临床药学（C错）。中药药剂学（D错）是以中医药理论为指导，运用现代科学技术，研究中药药剂的配制理论、生产技术、质量控制与合理应用等内容的一门综合性应用技术学科。